患者，男，35岁。低热乏力盗汗2周，咳嗽咯血3天，疑为肺结核。该病确诊的依据是
A. 结核菌素试验
B. 细菌学检查
C. 血沉
D. 胸部CT
E. 肺功能

正确答案：B。细菌学检查

解析：如咳嗽持续2周以上，咯血，午后低热，乏力，盗汗，月经不调或闭经，出现这些症状要考虑肺结核病的可能，需进行痰抗酸杆菌和胸部X线检查。如若痰中找到结核杆菌即可诊断为肺结核，故细胞学检查是肺结核的确诊依据（B对）。而结核菌素阳性并不一定就说明病人感染了结核病（A错）。